下列哪项属于开放性损伤
A. 裂伤
B. 挫伤
C. 扭伤
D. 爆震伤
E. 挤压伤

正确答案：A。裂伤

解析：开放性损伤多由锐性物体和高速运动的物体打击所致，裂伤属于开放性损伤（A对）。闭合性损伤包括：挫伤（B错），扭伤（C错），挤压伤（E错），震荡伤，冲击伤又叫爆震伤（D错），关节脱位和半脱位。